大部分急性心肌梗死的病因是
A. 冠状动脉内动脉粥样斑块破裂，血栓形成
B. 冠状动脉痉挛，血栓形成
C. 动脉粥样斑块逐渐进展直至完全阻塞冠状动脉管腔
D. 冠状动脉炎，血栓形成
E. 冠状动脉栓塞，继发血栓形成

正确答案：A。冠状动脉内动脉粥样斑块破裂，血栓形成

解析：大部分急性心肌梗死的病因是不稳定的粥样斑块溃破，继而出血和管腔内血栓形成，而使管腔闭塞（A对C错）。少数情况下冠状动脉痉挛，血栓形成（B错）。偶为冠状动脉炎，血栓形成（D错）；冠状动脉栓塞，继发血栓形成（E错）。